男，67岁，便秘7天。不宜选择检查
A. 腹部平片
B. 上消化道钡剂造影
C. CT
D. MRI
E. 无禁忌

正确答案：B。上消化道钡剂造影

解析：上消化道钡剂造影就是经过吞食糊状硫酸钡（显影剂）后，通过钡剂在经食道到达胃、十二指肠部位的显影过程来进行上消化道疾病诊断的方法。本例患者为老年男性，便秘7天，考虑存在肠梗阻，当临床怀疑或者确诊有肠梗阻时，严禁使用硫酸钡造影，因此本患者不宜选择检查是上消化道钡剂造影（B错，为本题正确答案）。腹部平片（A错）、CT（C错）、MRI（D错）都是影像学检查，可用于胃肠道疾病的辅助检查。